远志中具有祛痰作用的有效成分主要是
A. 皂苷类成分
B. 蒽醌类成分
C. 树脂类成分
D. 生物碱类成分
E. 酚酸类成分

正确答案：A。皂苷类成分

解析：本题考查远志的有效化学成分。远志中具有祛痰作用的有效成分主要是皂苷类成分（A对）。远志【功效】安神益智，祛痰开窍，消散痈肿。远志主要含三萜皂苷类成分，包括远志皂苷A、B、C、D、E、F、G。尚含脂肪油，树脂（C错）、远志糖醇、葡萄糖、果糖、远志碱等。芦荟中主要蒽醌类成分（B错）的药理作用：大黄酸有抑菌、抗病毒作用，大黄素、芦荟大黄素有抗肿瘤的作用，芦荟酸和芦荟泻素的药用价值为健胃和通便，芦荟霉素具有抗癌、抗病毒、抗菌的作用。麻黄水煎液、麻黄醇提取物、麻黄生物碱（D错）、麻黄碱均具有平喘、镇咳作用。麻黄挥发油具有祛痰作用。当归中有机酚酸（E错）的化学结构当归中主要含有有机酸类成分、挥发油和多糖类成分。有机酸类成分主要包括阿魏酸、香草酸、烟酸和琥珀酸等。